根据片剂中各亚剂型设计特点，起效速度最快的剂型是
A. 普通片
B. 控释片
C. 多层片
D. 分散片
E. 肠溶片

正确答案：D。分散片

解析：本题考查分散片。起效速度最快的剂型是分散片（D对），分散片是指水中能迅速崩解并均匀分散的片剂。普通片（A错）即普通压制片，是指将药物与辅料混合压制而成，一般用水吞服，应用最广；控释片（B错）是指在规定的释放介质中缓慢地恒速释放药物的片剂；多层片（C错）是指由两层或多层（配方或色泽不同）组成的片剂；肠溶片（E错）是指用肠溶性包衣材料进行包衣的片剂。